下列疾病中，较少发生大咯血的是
A. 二尖瓣狭窄
B. 支气管扩张
C. 肺脓肿
D. 空洞型肺结核
E. 粟粒型肺结核

正确答案：E。粟粒型肺结核

解析：咯血的原因很多，主要见于呼吸系统和心血管疾病。呼吸系统疾病常见于支气管扩张（B对）、肺脓肿（C对）和空洞型肺结核（D对）等，其咯血的机制为病变累及支气管或肺部血管，使血管壁破损发生大量咯血。心血管疾病常见于二尖瓣狭窄（A对），其引起肺淤血，造成肺泡壁或支气管内毛细血管破裂和支气管粘膜下层支气管静脉曲张破裂，引起大咯血。急性血型播散型肺结核（E错，为本题正确答案）为结核分枝杆菌进入血液造成肺部病变，较少出现咯血。